职业病是指
A. 劳动者在职业活动中，因接触粉尘、放射性物质和其他有毒、有害物质等因素而引起的疾病
B. 用人单位的劳动者，因接触粉尘、放射性物质和其他有毒、有害物质等因素而引起的疾病
C. 用人单位的劳动者在职业活动中，因接触粉尘、放射性物质和其他有毒、有害物质等因素而引起的疾病
D. 劳动者从事特定职业或者接触特定职业危害因素而引起的疾病
E. 用人单位的劳动者从事特定职业或者接触特定职业危害因素而引起的疾病

正确答案：C。用人单位的劳动者在职业活动中，因接触粉尘、放射性物质和其他有毒、有害物质等因素而引起的疾病